某儿童身高等级评价结果，在+1～+2个标准差之间为
A. 下等
B. 中等
C. 中上等
D. 中下等
E. 上等

正确答案：C。中上等

解析：本题考查体格发育评价的相关内容。五等级划分法将测量数值分为上＞x̅+2SD、中上x̅+（1SD～2SD）（C对ABDE错）、中x̅±1SD、中下x̅-（1SD～2SD）、下＜x̅-2SD。